眼刺激试验使用家兔数量为
A. 2～3只
B. 3～4只
C. 4～5只
D. 5～6只
E. 6～7只

正确答案：B。3～4只